迷走神经
A. 经颈动脉管出入颅
B. 参与心丛形成
C. 颈部的分支仅支配喉肌
D. 前干仅分布于胃前壁
E. 后干分布于腹腔内所有脏器

正确答案：B。参与心丛形成

解析：迷走神经与舌咽神经和副神经一起穿颈静脉孔出颅（A错）。迷走神经发出颈心支，入胸腔后于心底部与交感神经的节后纤维一起形成心丛（B对），调控心脏活动。迷走神经在颈部的分支支配分布于硬脑膜、外耳道及耳郭后面的皮肤及喉肌的运动（C错）。迷走神经的前干入腹腔后分胃前支和肝支，胃前支分布于胃前臂，肝支脉分布于肝、胆囊和胆道（D错），后干入腹腔后分胃后支和腹腔支，腹腔支与交感神经一起分别于腹腔干、肠系膜上动脉和肾动脉根部形成神经丛，并随这些动脉及其分支分布于胰、脾、肾以及结肠左曲以上的消化管（E错）。